治疗皮肤黏膜淋巴结综合征卫气同病，应首选
A. 凉膈散
B. 新加香薷饮
C. 白虎汤
D. 银翘散合白虎汤
E. 清营汤

正确答案：D。银翘散合白虎汤

解析：皮肤黏膜淋巴结综合征卫气同病是由于外感温热毒邪，犯于肺卫，传于气分所致，治疗时应清热解毒，辛凉透表，首选银翘散合白虎汤（D对）。凉膈散（A错）其功用为泻火通便，清上泻下，适用于上中二焦邪郁生热证。新加香薷饮（B错）其功用为祛暑解表，清热化湿，适用于暑邪感冒。白虎汤（C错）其功用为清热生津，适用于气分热盛证。清营汤（E错）其功用为清营解毒，透热养阴，适用于热入营分证。